对出血坏死型胰腺炎最具诊断价值的是
A. 血脂肪酶增高
B. 血淀粉酶增高
C. 血钙降低
D. 血胆红素增高
E. B超检查胰腺增大

正确答案：C。血钙降低

解析：出血坏死型胰腺炎（即重症急性胰腺炎）患者，Ca2+内流入腺泡细胞，胰腺坏死钙化，血钙浓度降低（＜2mmol/L），而水肿型胰腺炎无明显血钙浓度变化，对出血坏死型胰腺炎具有诊断价值（C对）。血淀粉酶、血脂肪酶的高低与病情程度无确切关联，部分患者两种酶均不升高（AB错）。血胆红素增高多见于肝胆疾病、急性溶血及壶腹部肿瘤导致胆总管流出道梗阻等情况，胰腺炎患者少见（D错）。水肿型及坏死型胰腺炎均有B超检查胰腺增大表现（E错）。